具有遏制、清除突变细胞的功能是
A. 免疫自稳
B. 免疫传输
C. 免疫监视
D. 免疫阻抗
E. 免疫防御

正确答案：C。免疫监视

解析：免疫监视是免疫系统遏制、清除突变细胞的功能。免疫监视功能缺陷的个体发生肿瘤的几率增加。掌握“基本概念”知识点。